女，45岁。近一年来盗汗、心悸、易怒，食量增加。检查：突眼，心率110次/分，血压126/84mmHg，甲状腺弥漫性肿大Ⅲ°，心律齐、无杂音，举手颤动明显。查血T₃、T₄高于正常值。诊为原发性甲亢，经抗甲状腺药物治疗后复发，拟行甲状腺双侧次全切除术。该病人手术后最危急的并发症是
A. 手术区出血压迫气管
B. 双侧喉上神经损伤
C. 一侧喉返神经损伤
D. 甲状腺危象
E. 手术切口化脓性感染

正确答案：A。手术区出血压迫气管

解析：甲状腺次全切术后手术区出血压迫气管（A对）是最危及的术后并发症，可导致患者迅速窒息死亡。双侧喉上神经损伤（B错）可引起声带松弛、音调降低以及饮水呛咳；一侧喉返神经损伤（C错）大都引起声嘶，以上两种并发症均不危及生命，并非术后最危险的并发症。甲状腺危象（D错）是术后的严重并发症，亦需及时处理，但危急程度不如气管受压。甲状腺大部切除术切口为Ⅰ类切口，遵循严格的无菌操作标准，极少发生手术切口化脓性感染（E错），且切口感染并非危急的并发症。